根据阴阳对立制约确定的治法是
A. 阴病治阳
B. 阳病治阴
C. 阴中求阳
D. 寒者热之
E. 阳中求阴

正确答案：D。寒者热之

解析：阴阳对立，指阴阳“一分为二”，即对待相反的关系，是事物或现象固有的属性。阴阳学说认为，对立相反是阴阳的基本属性，宇宙间很多事物和现象都存在对立相反的两个方面。如天与地、日与月、水与火、男与女、寒与热、动与静、上与下、左与右等。阴阳对立制约的意义，在于防止阴阳的任何一方不至于亢盛为害，以维持阴阳之间的协调平衡（D对）。